治疗心绞痛急性发作的首选药物是
A. 硝酸甘油
B. 可乐定
C. 硝苯地平
D. 卡托普利
E. 维拉帕米

正确答案：A。硝酸甘油

解析：硝酸甘油适用于治疗各种类型的心绞痛，其中对于稳定型心绞痛为首选药。控制急性发作时，应舌下含服或气雾吸入（A对）。可乐定用于治疗中度高血压，适用于兼有溃疡病的高血压及肾性高血压患者（B错）。硝苯地平可用于轻、中、重各型高血压，对高血压伴有心绞痛、糖尿病、脑血管病、肾功能不良等并发症疗效好（C错）。卡托普利应用于：①慢性心功能不全②心肌梗死（D错）。用于稳定型和不稳定型心绞痛，对伴有心律失常的心绞痛患者尤其适用（E错）。